主要来源与下颌智牙冠周炎及下颌磨牙的根尖周炎扩散，偶有因化脓性腮腺炎波及的间隙感染是
A. 咬肌间隙感染
B. 眶下间隙感染
C. 下颌下间隙感染
D. 翼下颌间隙感染
E. 颞下间隙感染

正确答案：A。咬肌间隙感染

解析：咬肌间隙感染来源主要来自下颌智牙冠周炎及下颌磨牙的根尖周炎扩散而进入咬肌间隙；也可来源于磨牙后三角区黏膜的感染；相邻间隙如颞下间隙感染的扩散；偶有因化脓性腮腺炎波及者。掌握“翼下颌间隙、颞下间隙感染”知识点。